次聚糖具抗肿瘤活性的药材是
A. 冬虫夏草
B. 茯苓
C. 灵芝
D. 猪苓
E. 雷丸

正确答案：B。茯苓

解析：本题考查的是茯苓的成分。次聚糖具抗肿瘤活性的药材是茯苓（B对）。茯苓【成分】茯苓聚糖无抗肿瘤活性，若切断其支链，成为单纯的β-（1→3）葡萄糖聚糖，称为茯苓次聚糖，具抗肿瘤活性。冬虫夏草（A错）【成分】腺苷、虫草酸和虫草素是冬虫夏草的主要活性物质。灵芝（C错）【成分】赤芝含麦角甾醇0.3%～0.4%、真菌溶菌酶及酸性蛋白酶，在水提液中含有水溶性蛋白质、氨基酸、多肽、生物碱、多种多糖类；多种苦味的三萜化合物：灵芝酸、赤芝酸、灵赤酸等。猪苓（D错）【成分】猪苓多糖有抗肿瘤作用，对细胞免疫功能的恢复有明显的促进作用。雷丸（E错）【成分】主要含一种蛋白酶（雷丸素），约含3%，系驱绦虫的有效成分，并含麦角甾醇、多糖、钙、铝、镁等。